会产生过敏反应的药物是
A. 青霉素G
B. 羧苄青霉素
C. 两者均可
D. 两者均不可

正确答案：C。两者均可

解析：本题考查会产生过敏反应的药物。青霉素G与羧苄青霉素均为青霉素类抗菌药物，青霉素在合成、生产过程中会引入杂质，引起过敏反应，甚至发生过敏性休克（C对）。